关于苯二氮草类药物的叙述，哪项错误
A. 是最常用的镇静催眠药
B. 治疗焦虑症有效
C. 可用于小儿高热惊厥
D. 可用于心脏电复律前给药
E. 长期用药不产生耐受性和依赖性

正确答案：E。长期用药不产生耐受性和依赖性